对重型肝炎临床诊断及预后判断有重要意义的是
A. 黄疸进行性加重
B. 凝血酶原活动40%
C. 血尿素氮升高
D. 精神行为异常
E. 腹水、中毒性鼓胀

正确答案：B。凝血酶原活动40%

解析：重型肝炎的诊断标准有：严重的消化道症状，如厌食、恶心、频繁呕吐；极度乏力；黄疸进行性加深；在数日内出现肝性脑病，腹水迅速增多或出现肝肾综合征；凝血酶原活动度（PTA）<40%。凝血酶原活动度（PTA）<40%（B对）对重型肝炎的诊断有重要意义，且PTA的变化也是判断重型肝炎预后的最敏感的实验室指标。黄疸进行性加重（A错）、血尿素氮升高（C错）、精神行为异常（D错）和腹水、中毒性鼓胀（E错）也可作为重型肝炎的临床诊断依据和预后不良的标志，但不如PTA≤40%诊断和预后意义大。